下列那种结构不属于心传导系
A. 窦房结
B. 房室束
C. 房室结
D. 结间束
E. 心丛

正确答案：E。心丛

解析：窦房结（A对）、房室束（B对）、房室结（C对）、结间束（D对）均属于心传导系的组成结构。心丛（E错，为本题正确答案）不属于心传导系。